消化性溃疡的典型临床表现是
A. 反复呕血、黑便
B. 慢性、周期性、节律性上腹痛
C. 反复上腹饱胀不适
D. 周期性发作的无节律性的上腹痛
E. 反复、节律性的消化不良

正确答案：B。慢性、周期性、节律性上腹痛

解析：消化性溃疡（PU）指胃肠道黏膜被自身消化而形成的溃疡，可发生于食管、胃、十二指肠、胃-空肠吻合口附近以及含有胃黏膜的Meckel憩室。胃、十二指肠球部溃疡最为常见。典型临床表现是慢性、周期性、节律性上腹痛（B对），性质可有钝痛、灼痛、胀痛、剧痛、饥饿样不适。反复呕血、黑便（A错）是上消化道出血（P452）的典型临床表现。反复上腹饱胀不适（C错）是慢性胃炎（P366）的典型临床表现。周期性发作的无节律性的上腹痛（D错）是胃癌的典型临床表现。反复、节律性的消化不良（E错）是功能性消化不良（P398）的典型临床表现。